孕妇感染梅毒的治疗，首选
A. 甲硝唑
B. 第三代头孢菌素
C. 青霉素
D. 红霉素
E. 阿奇霉素

正确答案：C。青霉素

解析：孕妇感染梅毒的治疗，首选青霉素（C对）。甲硝唑（P248）（A错）为滴虫性阴道炎或细菌性阴道病的首选用药。现有资料不足以推荐头孢菌素（B错）治疗孕妇梅毒。阿奇霉素（P106）（E错）为妊娠合并沙眼衣原体或支原体感染的首选用药。红霉素（D错）对孕妇和胎儿感染疗效差。